“寒从中生”是指
A. 寒邪伤人
B. 寒邪直中脾胃
C. 寒邪直中少阴
D. 寒邪从肌表而入，伤及内脏
E. 阳气虚衰，温煦气化功能减退

正确答案：E。阳气虚衰，温煦气化功能减退

解析：寒从中生，又称“内寒”，指机体阳气虚衰，温煦气化功能减退，虚寒内生，火阴寒之气弥漫的病机变化（E对）；寒邪伤人、寒邪直中脾胃、寒邪直中少阴、寒邪从肌表而入伤及内脏均指外感之寒邪伤及机体（ABCD错）。